休克在微循环衰竭期最突出的情况是
A. 血管内高凝状态
B. 后括约肌收缩状态
C. 代谢性碱中毒
D. 前括约肌收缩状态
E. 毛细血管内“可进可出”

正确答案：A。血管内高凝状态

解析：休克时微循环的变化分三期：1.微循环收缩期，此期毛细血管前括约肌收缩（D错）致“只出不进”；2.微循环扩张期，此期毛细血管前括约肌舒张，而后括约肌仍处于收缩状态（B错），致“只进不出”；3.微循环衰竭期，瘀滞在微循环内的黏稠血液在酸性环境中处于高凝状态（A对），此时微循环呈现“不进不出”的状态（E错）。休克时外周循环障碍，细胞对氧的需求不能满足而进行无氧糖酵解，引起代谢性酸中毒（C错）。